下列药物中，哪种不具有抗高血压作用
A. 氯贝丁酯
B. 甲基多巴
C. 盐酸普萘洛尔
D. 利血平
E. 卡托普利

正确答案：A。氯贝丁酯

解析：本题考查抗高血压药。氯贝丁酯（A错，为本题正确答案）为贝丁酸类降血脂药，能够显著降低甘油三酯。甲基多巴（B对）是一种α₂受体激动型心血管药物，能够降低血压。盐酸普萘洛尔（C对）为非选择性β受体阻断药，通过阻断心肌β受体发挥降压作用。利血平（D对）是肾上腺素能神经元阻断性抗高血压药。卡托普利（E对）为血管紧张素转化酶抑制剂，对多种类型高血压均有明显降压作用，并能改善充血性心力衰竭患者的心脏功能。